湿热熏蒸的面色是
A. 黄而鲜明
B. 黄如烟薰
C. 苍黄
D. 淡黄消瘦
E. 淡黄浮肿

正确答案：A。黄而鲜明

解析：黄色，主虚证，湿证。黄而鲜明如橘子色者，属“阳黄”，因湿热熏蒸所致（A对）。黄如烟熏即黄而晦暗如烟熏者，属“阴黄”，因寒湿郁阻所致（B错）。苍黄，即黄中透青，因肝郁脾虚所致（C错）。淡黄消瘦，多因胃病虚热所致（D错）。淡黄浮肿，即“黄胖”，多因脾气虚衰，湿邪内阻所致（E错）。